血液毒性痛风患者体内异常代谢的物质是
A. 葡萄糖
B. 嘌呤
C. 胆固醇
D. 儿茶酚胺
E. 肾素

正确答案：B。嘌呤

解析：本题考查痛风。血液毒性痛风患者体内异常代谢的物质是嘌呤（B对）。尿酸为嘌呤代谢产物，血尿酸过高时，尿酸钠盐将过饱合而形成结晶体，沉积于关节、软组织、软骨及肾等体温较低的部位，而致关节炎、尿路结石及肾疾病，称为痛风。